临床一期梅毒，多于不洁性交后出现，其时间是
A. 5周左右
B. 4周左右
C. 3周左右
D. 2周左右
E. 1周左右

正确答案：C。3周左右

解析：梅毒螺旋体由直接或间接途径，经黏膜或破损皮肤进入机体后即在侵入处组织中繁殖，于外生殖器处形成硬下疳，称为一期梅毒。一般有不洁性交史，或性伴侣有梅毒病史，发生于不洁性交后约3周（C对），常发生在外生殖器部位。